肱骨外上髁炎诊断依据是
A. Mills征阳性
B. Dugas征阳性
C. Thomas征阳性
D. Lasegue试验阳性
E. Finkelstein试验阳性

正确答案：A。Mills征阳性

解析：肱骨外上髁炎诊断依据是Mills征阳性（A对），即伸肘，握拳，屈腕，前臂旋前时，肘外侧出现疼痛。Lasegue试验（直腿抬高试验）阳性（D错）主要见于腰椎间盘突出症、梨状肌综合征等所致的坐骨神经损伤；Dugas征阳性（B错）是肩关节脱位的典型体征；Thomas征（P758）阳性（C错）说明患侧髋关节有屈曲挛缩畸形；Finkelstein试验阳性（E错）是桡骨茎突狭窄性腱鞘炎的典型体征。